间接固位体的作用是
A. 增强义齿的固位、稳定和强度
B. 增强义齿的固位、稳定和美观
C. 增强义齿的固位、支持和强度
D. 增强义齿的固位、支持和稳定
E. 增强义齿的固位、支持和舒适

正确答案：D。增强义齿的固位、支持和稳定

解析：本题考查间接固位体的作用。间接固位体的作用就是为了增强义齿的固位、支持和稳定（D对）。连接体可以增加义齿的强度（AC错）。间接固位体的增加有可能会导致金属的显露，并不利于美观（B错），且造成舌感不适（E错）。